患者反复呕吐隔餐食物，查体：消瘦，上腹部膨胀，并见胃型。应首先考虑的是
A. 肝炎
B. 肝硬化
C. 胃炎
D. 幽门梗阻
E. 胆囊炎

正确答案：D。幽门梗阻

解析：患者反复呕吐隔餐食物查体：消瘦，上腹部膨胀，并见胃型应首先考虑的是幽门梗阻，是由于幽门通过障碍，胃内容物不能顺利入肠，而在胃内大量潴留，导致胃壁肌层肥厚、胃腔扩大及胃黏膜层的炎症、水肿及糜烂。表现为长期不能正常进食，并大量呕吐，导致严重的营养不良、低蛋白血症及贫血，并有严重脱水、低钾及碱中毒等水、电解质紊乱（D对）。肝炎通常是指由多种致病因素--如病毒、细菌、寄生虫、化学毒物、药物、酒精、自身免疫因素等使肝脏细胞受到破坏，肝脏的功能受到损害，引起身体一系列不适症状，以及肝功能指标的异常（A错）。肝硬化可有肝炎临床表现，亦可隐匿起病。可有轻度乏力、腹胀、肝脾轻度大、轻度黄疸，肝掌、蜘蛛痣（B错）。胃炎主要表现为上腹痛、腹胀、嗳气、食欲减退、恶心、呕吐等（C错）。胆囊炎表现为右上腹剧痛或绞痛、恶心、呕吐、畏寒、寒战、发热（E错）。